孕妇感染梅毒首选的治疗药物是
A. 阿奇霉素
B. 青霉素
C. 多西环素
D. 氧氟沙星
E. 头孢曲松

正确答案：B。青霉素

解析：阿奇霉素可用于淋病患者单次肌内注射的患者，是妊娠期感染沙眼衣原体首选用药（A错）；青霉素常用于治疗梅毒的首选治疗用药（B对）；多西环素常用于治疗沙眼衣原体或支原体引起的感染（C错），妊娠期妇女禁用该药；氧氟沙星作为第三代喹诺酮类药物，常用于伤寒的首选治疗（D错）；治疗淋病推荐联合使用头孢菌素和阿奇霉素，首选头孢曲松钠250mg（E错）。